目前确定乳腺肿块性质最可靠的方法是
A. X线检查
B. B超
C. 近红外线扫描
D. 液晶热图像
E. 活组织病理检查

正确答案：E。活组织病理检查

解析：目前确定乳腺肿块性质最可靠的方法是活组织病理检查（E对），通过穿刺或肿块完整切除取得病理标本，观察细胞形态及局部组织结构从而明确肿块性质。包括钼靶X线及干板照相在内的X线检查（A错）主要用于乳腺癌的筛查，其意义主要在于发现肿块；B超（B错）主要用于鉴别肿块系囊性还是实性；近红外线扫描（C错）为显示乳腺肿块的检查；液晶热图像（D错）系根据癌细胞代谢快，产热较周围组织高，液晶膜可将乳房表面温差变为肉眼可见的图像，从而显示热区肿瘤，可初步区分肿块的良恶性。四种影像学检查对判断肿块性质有一定提示意义，但均不能明确肿块性质。